cAMP对转录进行调控，必须先与
A. CAP结合，形成cAMP-CAP复合物
B. RNA聚合酶结合，从而促进该酶与启动子结合
C. G蛋白结合
D. 受体结合
E. 操纵基因结合

正确答案：A。CAP结合，形成cAMP-CAP复合物

解析：cAMP为环腺苷酸，是由三磷酸腺苷（ATP）脱去两个磷酸缩合而成，在动植物中微量存在，被称为细胞内的“第二信使”。原核基因乳糖操纵子受到阻遏蛋白的负性调节与分解（代谢）物基因激活蛋白（CAP）的正性调节。CAP是一种典型的激活蛋白，属于同二聚体，在其分子内有DNA结合区及cAMP结合位点。当没有葡萄糖及cAMP浓度较高时，cAMP与CAP结合，可刺激RNA转录活性。掌握“基因表达调控原理”知识点。